鹤虱的原植物属于
A. 豆科
B. 十字花科
C. 伞形科
D. 茄科
E. 菊科

正确答案：E。菊科